女，26岁。外阴瘙痒，起丘疹，肿物1个月，有不洁性交史，阴道分泌物增多，查大小阴唇可见鸡冠状肿物，表面呈乳头状，实验室醋酸白试验阳性。患者的诊断是
A. 尖锐湿疣
B. 梅毒
C. 扁平湿疣
D. 淋病
E. 生殖器疱疹

正确答案：A。尖锐湿疣

解析：青年女性，有不洁性交史，外阴瘙痒（尖锐湿疣可有外阴瘙痒症状），起丘疹并出现肿物，阴道分泌物增多，大小阴唇可见鸡冠状肿物，表面呈乳头状（尖锐湿疣的病灶初为散在或呈簇状增生的粉色或白色小乳头状疣），实验室醋酸白实验阳性，即5%醋酸实验对于诊断尖锐湿疣的价值很大，应首先考虑尖锐湿疣（A对）。梅毒（P102）（B错）早期主要表现为硬下疳、硬化性淋巴结炎、全身皮肤黏膜损害（如扁平湿疣（C错）等），晚期表现为永久性皮肤黏膜损害，并可侵犯心血管、神经系统等多种组织器官而危及生命。淋病（P101）（D错）主要表现为宫颈炎，输卵管炎等炎症表现，无赘生物。生殖器疱疹（P105）（E错）主要表现为生殖器及肛门皮肤散在或簇集小水泡，常伴发热，头痛等全身症状。